支配虹膜环状肌的受体是
A. N受体
B. M受体
C. α受体
D. β受体
E. 多巴胺受体

正确答案：B。M受体

解析：支配虹膜环状肌的受体是M受体（B对），M受体激动后引起瞳孔缩小。N受体（A错）可分为N1和N2受体两种亚型，前者分布于中枢神经系统和自主神经节后神经元上，因而又称神经元型烟碱受体；后者位于骨胳肌神经-肌接头处的终板膜中，所以也称肌肉型烟碱受体，与支配虹膜环状肌的受体没有关系。虹膜辐射肌存在的α1受体（C错），其激动后，引起瞳孔扩大。β受体（D错）主要存在于心肌以及血管、子宫、小肠、支气管的平滑肌还有脂肪组织。多巴胺（E错）系统主要存在于中枢，包括黑质-纹状体、中脑-边缘前脑、结节-漏斗三条通路。